确定国家基本药物制度框架的机构是
A. 国家卫生健康委员会
B. 国家发展和改革委员会
C. 人力资源和社会保障部
D. 国家食品药品监督管理局
E. 国家基本药物工作委员会

正确答案：E。国家基本药物工作委员会

解析：本题考查的是基本药物管理部门及职能。确定国家基本药物制度框架的机构是国家基本药物工作委员会（E对）。基本药物管理部门及职能：国家基本药物工作委员会负责协调解决制定和实施国家基本药物制度过程中各个环节的相关政策问题，确定国家基本药物制度框架，确定国家基本药物目录遴选和调整的原则、范围、程序和工作方案，审核国家基本药物目录，各有关部门在职责范围内做好国家基本药物遴选调整工作。国家基本药物工作委员会由国家卫生健康委员会（A错）、国家发展和改革委员会（B错）、工业和信息化部、监察部、财政部、人力资源和社会保障部（C错）、商务部、国家药品监督管理局（D错）、国家中医药管理局组成。办公室设在国家卫生健康委员会，承担国家基本药物工作委员会的日常工作。